干性胸膜炎的胸痛特点是
A. 精神紧张诱发
B. 含化硝酸甘油减轻
C. 呼吸时加重，屏气时消失
D. 压迫加剧
E. 进食加剧

正确答案：C。呼吸时加重，屏气时消失

解析：干性胸膜炎是结核性胸膜炎的早期表现，病理表现为胸膜充血、水肿、表面有少量纤维蛋白性渗出物，多发生于青壮年，胸痛性质呈隐痛、钝痛、刺痛，常位于患侧胸部、腋下，可因咳嗽或呼吸而加重（C对）。含化硝酸甘油减轻（B错）是指硝酸甘油通过扩张外周静脉和小动脉，减少回心血量，降低前负荷，同时增加心肌营养供应，从而缓解胸痛，是心绞痛、心肌梗死的胸痛特点。压迫加剧（D错）可见于多种致胸痛的疾病。进食加剧（E错）是由于刺激性食物刺激食管炎性区域导致，常见于一些食管疾病。精神紧张诱发（A错）是指精神紧张状态导致的脏器血供相对不足，多见于心绞痛，也可见于食管疾病。